患者，女，28岁，妊娠27周，头晕3天。入院查体：血压160/100mmHg，诊断为：妊娠高血压。患者出现先兆子痫，急救时应首选的药物是
A. 硫酸镁注射液
B. 甲氧氯普胺注射液
C. 葡萄糖酸钙注射液
D. 尼莫地平注射液
E. 乌拉地尔注射液

正确答案：A。硫酸镁注射液

解析：本题考查降压药。硫酸镁（A对）是治疗严重先兆子痫的首选药物。葡萄糖酸钙注射液（C错）用于预防和治疗钙缺乏症。拉贝洛尔（D错）用于治疗妊娠期妇女高血压。乌拉地尔注射液（E错）用于治疗高血压危象、重度和极重度高血压以及难治性高血压。